由于受上游化工企业废水长期排放的影响，导致某江河严重污染，沿江渔民普遍出现周围型感觉障碍、向心性视野缩小、听力下降、神经性耳聋等中毒的体征。人体暴露于该污染物主要通过
A. 饮水
B. 稻米
C. 蔬菜
D. 奶制品
E. 水产品

正确答案：E。水产品

解析：本题考查人体暴露于甲基汞的方式。慢性甲基汞中毒是人群长期暴露于被汞（甲基汞）污染的环境，主要是水体汞（甲基汞）污染和由此导致的鱼贝类等食物甲基汞污染，造成摄入者体内甲基汞蓄积并超过一定阈值所引起的以中枢神经系统损伤为主要中毒表现的环境污染性疾病。因此，人体暴露于甲基汞主要通过水产品（E对ABCD错）。